根尖周组织病的病因不包括
A. 创伤
B. 化学刺激
C. 感染
D. 电流刺激
E. 免疫因素

正确答案：D。电流刺激

解析：本题考查根尖周组织病的病因。在日常生活中，电流刺激（D错，为本题的正确答案）牙髓及其少见，临床上所见电流刺激牙髓，多发生在相邻或对颌牙上用了两种不同的金属修复体，咬合时产生电流，刺激牙髓，长时间后可引起牙髓病变，但一般未及引起根尖周组织的病变，患者已因疼痛等因素寻求治疗。引起根尖周病的原因主要有感染（C对）、急慢性创伤（A对）等物理因素、化学刺激（B对）以及免疫反应（E对）等。